鹅口疮的病位是
A. 肝胆脾
B. 肝脾胃
C. 脾肝肾
D. 心肺肾
E. 心脾肾

正确答案：E。心脾肾

解析：鹅口疮病位在心脾肾，因少阴之脉通于舌，太阴之脉通于口，火热循经上扰而发病（E对）。